女，23岁。G₀P₀。右下腹隐痛半个月，加重5小时。月经不规律，查体：T37.0℃，P96次/分，R23次/分，BP105/75mmHg。妇科检查：子宫右旁可触及大小约6cm的实性包块，触痛，子宫及左侧附件未触及异常。血清AFP900μg/t。术后首选的治疗方式是
A. 化学治疗
B. 放射治疗
C. 生物治疗
D. 内分泌治疗
E. 随访观察

正确答案：A。化学治疗

解析：患者年轻女性，G₀P₀（卵巢卵黄囊瘤的好发人群）。右下腹隐痛半个月并加重，月经不规律（卵巢卵黄囊瘤的临床表现），妇科检查：子宫右旁可触及大小约6cm的实性包块，触痛，子宫及左侧附件未触及异常（卵巢肿瘤的检查体征）。血清AFP900μg/t（正常值为0～25ug/L，卵巢卵黄囊瘤的诊断及病情监测的重要标志物）。根据患者的病史、临床表现和辅助检查，可初步考虑诊断为卵巢卵黄囊瘤。卵巢生殖细胞肿瘤包括畸胎瘤、无性细胞瘤、卵黄囊瘤，除Ⅰ期无性细胞瘤和Ⅰ期、G1的未成熟畸胎瘤外，其他患者均需化疗，所以该患者保留生育功能的分期手术术后应该首选的治疗方式为化学治疗（A对）。